有关宫外孕，下述哪项是正确的
A. 以间质部妊娠最常见
B. 一般子宫增大情况与停经天数相符
C. 子宫内膜也发生蜕膜变化
D. 阴道流血多，易致失血性休克
E. 后穹隆穿刺阴性可否定宫外孕

正确答案：C。子宫内膜也发生蜕膜变化

解析：宫外孕时子宫内膜受甾体激素的影响会出现蜕膜反应，选C。A项宫外孕以输卵管妊娠多见，占95%左右，其中壶腹部妊娠最多见，约占78%；B项一般子宫增大情况与停经天数不相符；输卵管间质部妊娠时，子宫大小与停经月数基本相符，但是子宫不对称，一侧角部突出；C项其和正常妊娠一样，合体滋养细胞产生的hCG维持黄体生长，使甾体激素分泌增加，使月经停止来潮，子宫增大变软，子宫内膜出现蜕膜反应；D项阴道流血：不规则，一般不超过月经量，少数患者月经量较多，类似月经。不会引起失血性休克；E项阴道后穹隆穿刺：是一种简单可靠的诊断方法，适用于疑有腹腔内出血患者。掌握“异位妊娠”知识点。